医院内感染最多见的传播方式是
A. 注射、输液、输血传播
B. 接触传播
C. 医疗器械传播
D. 空气飞沫传播
E. 不洁药物传播

正确答案：D。空气飞沫传播